不属于食用油脂常用卫生学评价指标的是
A. 酸价
B. 过氧化值
C. 巴比妥酸
D. 丙二醛
E. 羰基价

正确答案：C。巴比妥酸

解析：本题考查食用油脂常用卫生学评价指标。食用油脂常用卫生学评价指标包括：1.酸价（A对）：指中和1g油脂中游离脂肪酸所需氢氧化钾的毫克数；2.过氧化值（B对）：指油脂中不饱和脂肪酸被氧化形成过氧化物的量，以100g被测油脂使碘化钾析出碘的克数表示；3.羰基价（E对）：指油脂酸败时产生的含有醛基和酮基的脂肪酸或甘油酯及其聚合物的总量；4.丙二醛（D对）：是油脂氧化的最终产物，通常用来反映动物油脂酸败的程度。巴比妥酸（C错，为本题正确答案）的值可以表示丙二醛的浓度，但不是评价油脂的卫生学指标。